用联合疗法来治疗艾滋病属于
A. 一级预防
B. 二级预防
C. 三级预防
D. 常规报告
E. 哨点监测

正确答案：C。三级预防

解析：本题考查三级预防。用联合疗法来治疗艾滋病属于三级预防（C对ABDE错）。第三级预防又称临床预防或疾病管理，发生在疾病的症状体征明显表现出来之后。早期，通过适当的治疗缓解症状，预防疾病进一步恶化，预防急性事件的发生和复发，预防合并症和残疾的发生。到了疾病晚期，通过早期发现和管理合并症，对已经发生的残疾进行康复治疗，最大限度的恢复个体的机体功能和社会功能，提高生活质量，延长寿命。